通常所说血型是指
A. 红细胞膜上的受体类型
B. 红细胞表面特异凝集素的类型
C. 红细胞表面特异凝集原的类型
D. 血浆中特异凝集素的类型
E. 血浆中特异凝集原的类型

正确答案：C。红细胞表面特异凝集原的类型